间接固位体及可起间接固位作用的部件是
A. 金属舌板
B. 附加卡环
C. 连续卡环
D. （牙合）支托
E. 以上说法均正确

正确答案：E。以上说法均正确

解析：间接固位体及可起间接固位作用的部件：单个支托、连续卡环、金属舌、腭板、基托、附加卡环、（牙合）支托等。掌握“局部义齿人工牙及基托”知识点。